性寒，既泻下逐水，又去积杀虫的药是
A. 芫花
B. 牵牛子
C. 京大戟
D. 郁李仁
E. 番泻叶

正确答案：B。牵牛子

解析：本题考查的是牵牛子的性味归经与功效。性寒，既泻下逐水，又去积杀虫的药是牵牛子（B对）。牵牛子：【性味归经】苦，寒。有毒。归肺、肾、大肠经。【功效】泻下，逐水，去积，杀虫。芫花（A错）：【性味归经】辛、苦，温。有毒。归肺、肾、大肠经。【功效】泻水逐饮，祛痰止咳。外用杀虫疗疮。京大戟（C错）：【性味归经】苦、辛，寒。有毒。归肺、肾、大肠经。【功效】泻水逐饮，消肿散结。郁李仁（D错）：【性味归经】辛、苦、甘，平。归脾、大肠、小肠经。【功效】润肠通便，利水消肿。番泻叶（E错）：【性味归经】甘、苦，寒。归大肠经。【功效】泻热通便，消积健胃。